下列哪项不属于角质细胞分层
A. 角化层
B. 粒层
C. 棘细胞层
D. 基底层
E. 黏膜下层

正确答案：E。黏膜下层

解析：本题考查口腔黏膜基本结构。黏膜下层（E错，为本题正确答案）不属于角质细胞分层。角质细胞：角化的鳞状上皮主要由角质细胞构成，由表层至深层共分为四层：角化层（A对）、粒层（B对）、棘细胞层（C对）、基底层（D对）。